乳房表浅脓肿切开引流，最佳切口应选择为
A. 轮辐状切口
B. 横切口
C. “＋”字切口
D. “＋＋”切口
E. 竖切口

正确答案：A。轮辐状切口

解析：乳腺叶和输乳管均以乳头为中心呈放射状排列，因此乳房表浅脓肿切开引流的最佳切口为轮辐状切口（A对），可减少对乳腺叶和输乳管的损伤，减少术后乳瘘的形成。“十”字切口（C错）及“十十”切口（D错）可用于痈的切开引流。